治疗应首选
A. 健固汤
B. 四神丸
C. 六君子汤
D. 痛泻要方
E. 参苓白术散

正确答案：E。参苓白术散

解析：根据患者症状，患者因为脾虚失运，经行气血下注血海，脾气益虚，不能运化水液，湿渗大肠，则大便泄泻，溏薄；脾阳不振，则神疲肢软；脾虚运化失司，脘腹胀满，水湿泛溢肌肤，面浮肢肿，故治疗时要健脾渗湿，理气调经，选用参苓白术散（E对）。健固汤与四神丸合用作用温阳补肾，健脾止泻，主要用于经行泄泻的肾虚证（AB错）。六君子汤作用是益气健脾，燥湿化痰，主要治疗食少便溏，胸脘痞闷，呕逆的脾胃气虚兼有痰湿证（C错）。痛泻药方主要治疗肠鸣泄泻，大便泄泻，泻必腹痛，泻后痛减，而本题患者并无明显肠鸣腹痛的表现（D错）。